结构中引入甲磺酰基，通过氢键作用增大了与酶的结合能力，使药效增强的药物是
A. 阿托伐他汀钙
B. 氟伐他汀钠
C. 瑞舒伐他汀钙
D. 洛伐他汀
E. 普伐他汀钠

正确答案：C。瑞舒伐他汀钙

解析：本题考查他汀类药物。结构中引入甲磺酰基，通过氢键作用增大了与酶的结合能力，使药效增强的药物是瑞舒伐他汀钙（C对）。瑞舒伐他汀钙分子中的双环部分改成了多取代的嘧啶环，嘧啶环上引入的甲磺酰基作为氢键接受体和HMG-CoA还原酶形成氢键，增加了与酶的结合能力，抑制作用更强。阿托伐他汀钙（A错）是将分子中的双环改为了吡咯环，其含有二羟基戊酸。氟伐他汀钠（B错）是将分子中的双环改为吲哚环，并打开内酯环成盐。洛伐他汀（D错）含有羟基内酯结构和氢化萘环骨架。普伐他汀钠（E错）可看做将洛伐他汀的内酯环开环并与成盐，以及用羟基取代十氢萘环2位甲基的药物。